病毒复制周期的步骤不包括
A. 吸附与穿入
B. 脱壳
C. 生物合成
D. 扩散
E. 装配与释放

正确答案：D。扩散